全面了解人群膳食结构和营养状况的重要手段是
A. 膳食调查
B. 体格检测
C. 营养缺乏病临床检查
D. 营养调查
E. 营养监测

正确答案：D。营养调查